生理状态下最主要的呼吸方式
A. 鼻呼吸
B. 胸式呼吸
C. 腹式呼吸
D. 锁骨式呼吸
E. 口呼吸

正确答案：A。鼻呼吸

解析：生理状态下，鼻呼吸是主要的呼吸方式。掌握“吞咽、呼吸及言语”知识点。